脏腑中有“主津”作用的是
A. 脾
B. 胃
C. 大肠
D. 小肠
E. 三焦

正确答案：C。大肠

解析：该题考查脏腑的主要生理机能，属记忆内容。脾主运化，主统血（A错）。胃主受纳水谷，主腐熟水谷（B错）。大肠主传化糟粕，主津（C对）。小肠主受盛化物，主泌别清浊，主液（D错）。三焦主通行诸气，主运行水液（E错）。